炒法的目的在于
A. 便于调剂和制剂
B. 增强疗效
C. 降低毒性或消除副作用
D. 缓和或改变药性
E. 增强或产生止血作用

正确答案：A、B、C、D、E。便于调剂和制剂；增强疗效；降低毒性或消除副作用；缓和或改变药性；增强或产生止血作用

解析：本题考查炒法的目的。炒法的目的在于便于调剂和制剂（A对）、增强疗效（B对）、降低毒性或消除副作用（C对）、缓和或改变药性（D对）、增强或产生止血作用（E对）。炒制的目的是增强药效，缓和或改变药性，降低毒性或减少刺激，矫臭矫味，利于贮藏和制剂。根据炒法操作时加辅料与否，可分为清炒法（单炒法）和加辅料炒法（合炒法）。清炒法又根据加热程度不同而分为炒黄、炒焦和炒炭。加辅料炒法根据所加辅料的不同而分为麦麸炒、米炒、土炒、砂炒、蛤粉炒和滑石粉炒等法。炒炭的目的：经炒炭炮制后可使药物增强或产生止血、止泻作用。